可用作注射剂抗氧剂的是
A. 大豆磷脂
B. 苯酚
C. 氯化钠
D. 聚维酮
E. 亚硫酸钠

正确答案：E。亚硫酸钠

解析：本题考查的是注射剂的抗氧剂。可用作注射剂抗氧剂的是亚硫酸钠（E对）。抗氧剂：抗氧剂是一类易被氧化的还原剂。常用的抗氧剂有亚硫酸钠、亚硫酸氢钠和焦亚硫酸钠等，一般浓度为0.1%～0.2%。其中亚硫酸钠常用于偏碱性药液，亚硫酸氢钠和焦亚硫酸钠常用于偏酸性药液。常用增溶剂有聚山梨酯80、蛋黄卵磷脂、大豆磷脂（A错）等；聚山梨酯80、大豆磷脂、蛋黄卵磷脂也可用作乳化剂；甘油可用作助悬剂。抑菌剂的用量应能抑制注射液中微生物的生长，在制剂确定处方时，该处方的抑菌效力应符合《中国药典》抑菌效率检查法的规定。加有抑菌剂的注射液，仍应采用适宜的方法灭菌。静脉给药与脑池内、硬膜外、椎管内用的注射液均不得加抑菌剂。常用抑菌剂为0.5%苯酚（B错）、0.3%甲酚、0.5%三氯叔丁醇、0.01%硫柳汞等。常用渗透压调节剂有氯化钠（C错）、硼酸、葡萄糖、硼砂等。黏度调节剂适当增加滴眼剂的黏度，可减少刺激性，延缓混悬型眼用制剂的沉降、延长药液在眼内滞留时间，增强药效。常用的黏度调节剂有甲基纤维素、聚乙烯醇、聚维酮（D错）等。